急性阑尾炎患者，未及时就诊，出现右下腹部包块，有压痛，最可能的情况是
A. 阑尾坏疽穿孔
B. 阑尾类癌
C. 形成阑尾周围脓肿
D. 门静脉炎
E. 盲肠后位阑尾炎

正确答案：C。形成阑尾周围脓肿

解析：急性阑尾炎患者，出现右下腹部包块，有压痛，最可能的情况是形成阑尾周围脓肿（C对）。阑尾坏疽穿孔（A错）刚开始坏疽出现剧烈腹痛，穿孔后因阑尾腔压力剧减，腹痛可减轻。阑尾类癌（B错）少见，起病隐匿，几乎总是在阑尾切除时发现。盲肠后位阑尾炎（E错）的临床症状体征轻，易误诊。